男，33岁。消化性溃疡反复发作并出血3年，再出血1周，内科治疗无效，行手术治疗。术中见胃皱襞显著增厚，组织病理学检査发现明显的壁细胞增生。最可能导致上述病理改变的内源性物质是：
A. 转化生长因子-α
B. 促胃液素
C. 促胰液素
D. 生长抑素
E. 乙酰胆碱

正确答案：B。促胃液素

解析：患者男性，33岁，消化性溃疡反复发作并出血3年，再出血一周，内科治疗无效，行手术治疗。术中胃皱襞显著增厚，组织病理学检査发现明显的壁细胞增生，促胃液素（B对）是导致壁细胞增生并释放大量胃酸的最可能内源性物质。转化生长因子-a（A错）、促胰液素（C错）、生长抑素（D错）都是对壁细胞胃酸分泌有抑制作用。乙酰胆碱（E错）是由迷走神经分泌的促进壁细胞分泌的物质，但主要受迷走神经调节，相对于促胃液素而言，并不是主要促进壁细胞显著增生的物质。